中药保护品种延长保护期的规定有
A. 延长的保护期限由国务院卫生行政部门根据国家中药品种保护审评委员会的审评结果确定
B. 中药一级保护品种最多只能延长保护期两次
C. 中药一级保护品种每次延长的保护期不得超过第一次批准的保护期限
D. 重要二级保护品种在保护期满后最多可延长保护期十年
E. 中药二级保护品种在保护期满后可以延长保护期七年

正确答案：C、E。中药一级保护品种每次延长的保护期不得超过第一次批准的保护期限；中药二级保护品种在保护期满后可以延长保护期七年

解析：本题考查中药保护品种延长保护期的规定。中药保护品种延长保护期的规定：中药一级保护品种每次延长的保护期不得超过第一次批准的保护期限（C对）；中药二级保护品种在保护期满后可以延长保护期限，时间为7年（E对），由生产企业在该品种保护期满前6个月，依据条例规定的程序申报。